Gentamycin是
A. 庆大霉素
B. 阿米卡星
C. 妥布霉素
D. 四环素
E. 链霉素

正确答案：A。庆大霉素

解析：本题考查庆大霉素的英文。庆大霉素（A对）为氨基糖苷类抗菌药，英文名称为Gentamycin。阿米卡星（B错）为氨基糖苷类抗菌药，其英文名称为Amikacin，主要用于铜绿假单胞菌及部分其它假单胞菌所致的严重感染。妥布霉素（C错）为氨基糖苷类抗菌药，其英文名称为Tobramycin，抗菌谱与庆大霉素近似。四环素（D错）为广谱抑菌剂，英文名称为Tetracycline。链霉素（E错）属氨基糖苷类抗菌药，其英文名称为Streptomycin。